下列病毒的分离培养方法中不包括
A. 接种营养培养基
B. 动物接种
C. 细胞培养
D. 组织器官培养
E. 鸡胚培养

正确答案：A。接种营养培养基

解析：病毒分离培养方法：鸡胚接种；组织培养（将离体活组织块或分散的活细胞加以培养，统称为组织培养）；动物接种。掌握“病毒感染检查方法及防治原则”知识点。